修复时暂时冠制作方法有
A. 直接法和间接法
B. 简单法和复杂法
C. 一次法和二次法
D. 单次法和多次法
E. 解剖法和非解剖法

正确答案：A。直接法和间接法

解析：临床上应用最多的是树脂类暂时修复体。暂时冠应正确恢复缺损牙的牙冠形态，边缘密合，邻接关系及咬合关系正常，颜色尽量与余留牙协调一致。制作方法有直接法和间接法两种。掌握“暂时冠及印模与模型”知识点。